下列不是肾综合征出血热发生的原发性休克特点的是
A. 出现在病程的3～7天
B. 由血浆外渗引起
C. 血容量减少
D. 由继发感染引起
E. 血液浓缩血黏稠度增高

正确答案：D。由继发感染引起